外科治疗门静脉高压症的主要目的是
A. 解除脾亢
B. 消除腹水
C. 防治上消化道出血
D. 改善肝功能
E. 防治肝昏迷

正确答案：C。防治上消化道出血

解析：门静脉高压症可导致食管胃底静脉曲张破裂大出血，这是门脉高压症最常见的并发症，难以止血，死亡率高。其外科治疗最主要的目的就是防治上消化道出血（C对）。解除脾亢（A错）、消除腹水（B错）、改善肝功能（D错）、防止肝昏迷（E错）也可通过一定的外科治疗达到，但不是最主要的治疗目的。